女孩，6岁。因乳房增大，身高增长加速1年余，阴道出血5天就诊。体检：身高119cm，乳房B4期，阴毛P2期，手腕骨X线片示骨龄9岁。最可能的诊断是
A. 体质性性早熟
B. 单纯性乳房早发育
C. McCune2016U4-Albr1ght综合征
D. 先天性肾上腺皮质增生症
E. 原发性甲状腺功能减低症伴性早熟

正确答案：A。体质性性早熟

解析：由于不明原因导致的儿童性早熟称为体制性早熟，即特发性早熟。常青春期发育临床上可分为5期（Tanner 分期），性早熟患儿多提前。女性一般先有乳房发育，可有触痛，扪及乳核，逐渐发育成熟，成女性体态。继而大小阴唇发育，阴道分泌物增多及阴毛生长，然后月经来潮和腋毛出现。开始多为不规则阴道出血，亦无排卵，以后逐渐过渡到规则的周期性月经。男孩睾丸容积增大（≥4mL），逐渐阴茎增大，出现阴茎勃起及排精，并出现阴毛、痤疮、变声。由于过早发育引起患儿近期疯长，骨骼生长加速，骨龄提前，骨骺可提前融合，影响终身高。中枢性性早熟临床表现中第二性征发育的顺序与正常发育是一致的，但是明显提前并且加速（A对）。仅有乳房增大，无其他第二性征发育，且不伴有生长加速及骨龄提前变化，B超检查子宫、卵巢容积无明显青春期增大（B错）。McCune2016U4-Albright综合征本症是由于G蛋白α2016U4-亚基突变，可激活多种内分泌激素受体。患儿除性早熟表现外，尚伴有皮肤牛奶咖啡斑和骨纤维发育不良，部分患儿长期随访可发生多种内分泌腺体的肿瘤等病变。（C错）。先天性肾上腺皮质增生症由于皮质激素合成过程中所需酶的先天缺陷所致。目前能识别的六型，分别为：212016U4-羟化酶缺陷、11β2016U4-羟化酶缺陷、172016U4-羟化酶缺陷、3β羟脱氢酶缺陷、皮质酮甲基氧化酶缺陷及先天性类脂质性肾上腺增生，212016U4-羟化酶缺乏和3羟脱氢酶缺乏有男性化和失盐表现。出现低血钠、高血钾、循环衰竭、失盐危象，可发生于生后数周内，危及生命（D错）。甲状腺功能降低患儿未经甲状腺素及时替代治疗时可伴发性早熟，属于性早熟的特殊类型。其发生机制源于垂体负反馈激素的重叠性分泌，LH、PRL和TRH具有共同的调控机制，因T3、T4低下，负反馈使TRH升高，TSH的分泌增多，垂体增生。TSH与LH和FSH具有相同的亚单位，循环中亚单位和LH、FSH增多而诱发性早熟。患儿常有高泌乳素血症，还可有多囊卵巢和阴毛早生，但此类患者没有生长加速，反而是生长迟缓，智能情况视甲减程度而不同。早期患儿的血LH基础值升高，但在GnRH激发后不升高，病程较长后才转化为真正的CPP。身材矮小是其重要特征（E错）。